在我国蝇类的主要传播疾病方式是
A. 机械性传播
B. 生物性传播
C. 吸血性传播
D. 直接接触传播
E. 间接接触传播

正确答案：A。机械性传播

解析：本题考查机械性传播的概念。机械性传播（A对BCDE错）是指肠道传染病的病原体可以在苍蝇、蟑螂等非吸血节肢动物的体表和体内存活数天，但不在其体内发育。节肢动物通过接触、反吐和粪便将病原体排出体外，污染食物或餐具等，感染接触者。